心尖区收缩中期附加音并有收缩中晚期杂音者最可能的诊断为
A. 冠心病劳力型心绞痛
B. 风心病二尖瓣关闭不全
C. 二尖瓣脱垂
D. 扩张型心肌病
E. 乳头肌功能不全

正确答案：C。二尖瓣脱垂

解析：二尖瓣脱垂（C对）是指二尖瓣瓣叶在心脏收缩时向左心房脱垂，导致二尖瓣关闭不全，收缩中期时可在心尖部闻及喀喇音，为二尖瓣脱入左心房，瓣叶突然紧张或腱索的突然拉紧产生震动所致。随后出现收缩中晚期吹风样杂音，为二尖瓣关闭不全所致。冠心病劳力性心绞痛（A错）由于心肌缺血可导致二尖瓣关闭不全；扩张型心肌病（D错）由于心室腔扩大而导致相对性二尖瓣关闭不全；乳头肌功能不全（E错）也可导致二尖瓣关闭不全；这三种情况加上风心病二尖瓣关闭不全（B错）都可于心尖部闻及心尖部收缩期杂音，但不会出现收缩中期附加音。